许勒位片用来检查
A. 关节外侧1/3
B. 髁突器质性病变
C. 髁突高位骨折及髁突肿瘤
D. 对比两侧髁突内外径向的影像
E. 髁突骨折、发育不足、肉瘤

正确答案：A。关节外侧1/3

解析：本题考查X线平片检查。许勒位片用来检查关节外侧1/3（A对）。髁状突器质性改变（B错）、髁突高位骨折及髁突肿瘤（C错），多用髁状突经咽侧位片。对比两侧髁突内外径向的影像（D错），髁突骨折、发育不足、肉瘤（E错），多用下颌骨开口后前位。